下列关于肠破裂的叙述错误的是
A. 十二指肠破裂的发生率最高
B. 十二指肠破裂多发生在第二、三段
C. 十二指肠破裂发生在腹腔内部分可早期引起腹膜炎
D. 小肠破裂可行一期修补或切除后一期吻合
E. 直肠破裂可行乙状结肠双管造口，2～3月后处理

正确答案：A。十二指肠破裂的发生率最高

解析：小肠占据中、下腹的大部分空间，受伤的机会较多，在腹部损伤中最容易发生肠破裂（A错，为本题正确答案）。十二指肠位置较深，损伤的发生率较低，约占整个腹部损伤的1.16％；损伤较多见于十二指肠的二、三段（B对）。十二指肠破裂如发生在腹腔内部分，由于胰液和胆汁流入腹腔，早期即可引起腹膜炎（C对）。由于小肠液含有各种消化酶，不利于细菌生长，因此小肠内细菌含量少，相对比较清洁，破裂后可行一期修补或切除后一期吻合（D对）。直肠上段破裂应剖腹进行修复，严重者可切除后端端吻合，同时行乙状结肠双管造口，2～3个月后闭合造口（E对）；直肠下段破裂时，应充分引流，并施行乙状结肠造口术，使粪便改道直至直肠伤口愈合。